小蓟的功效是
A. 散瘀消痈
B. 活血定痛
C. 清热生津
D. 祛痰止咳
E. 解毒敛疮

正确答案：A。散瘀消痈

解析：本题考查小蓟的功效。小蓟的功效是散瘀消痈（A对）。小蓟【功效】凉血止血，散瘀消痈。三七【功效】化瘀止血，活血定痛（B错）。白茅根【功效】凉血止血，清热生津（C错），利尿通淋。侧柏叶【功效】凉血止血，祛痰止咳（D错），生发乌发。地榆【功效】凉血止血，解毒敛疮（E错）。